中药挥发油中萜类化合物的结构类型主要有
A. 单萜
B. 倍半萜
C. 二倍半萜
D. 三萜
E. 四萜

正确答案：A、B。单萜；倍半萜

解析：本题考查的是挥发油的组成成分。中药挥发油中萜类化合物的结构类型主要有单萜（A对）与倍半萜（B对）。挥发油也称精油，是存在于植物体内的一类可随水蒸气蒸馏、与水不相混溶的挥发性油状液体。挥发油的组成成分主要有四类：萜类化合物、芳香族化合物、脂肪族化合物、其他类化合物。其中萜类在挥发油的组成成分中所占比例最大，主要是单萜、倍半萜及其含氧衍生物。二倍半萜（C错）的存在形式为海绵、植物病菌、昆虫代谢物。三萜（D错）的存在形式为皂苷、树脂、植物乳汁。四萜（E错）的存在形式为植物胡萝卜素。